华法林引起的不良反应是
A. 嗜睡乏力
B. 低血糖
C. 视觉异常
D. 出血
E. 骨质疏松

正确答案：D。出血

解析：本题考查华法林的不良反应。华法林主要不良反应是出血（D对）。嗜睡乏力（A错）常见于中枢神经系统抑制性药物如巴比妥类。低血糖（B错）常见于降糖药。视觉异常（C错）常见于钙离子拮抗剂如硝苯地平。骨质疏松（E错）常发生于糖皮质激素类药物。